下列哪一项不属于过敏性紫癜的好发部位
A. 下肢
B. 臀部
C. 上肢
D. 躯干
E. 面部

正确答案：E。面部

解析：过敏性紫癜是一种以小血管炎为主要病变的全身性血管炎综合征，以皮肤紫癜、关节肿痛、腹痛、便血及血尿、蛋白尿为主要临床表现。病程中反复出现皮肤紫癜为本病特点。多见于下肢（A对）、臀部（B对），部分累及上肢（C对）、躯干（D对），面部少见（E错，为本题正确答案）。典型皮疹初为小型荨麻疹或紫红色斑丘疹，高出皮肤，此后红斑中心发生点状出血，颜色加深呈棕褐色，并可融合成片，压之不退色，重症患儿大片融合成大疱伴出血性坏死。皮疹无压痛，无痒或微痒，分批出现，新旧并存，呈对称性分布。一般4～6周消退，不留痕迹；也可迁延数周或数月。